银汞合金性能的改进，主要着重于
A. 去除所含锌的成分
B. 采用屑形银合金粉
C. 去除所含银汞相
D. 去除所含锡汞相

正确答案：D。去除所含锡汞相

解析：本题考查银汞合金的种类与组成。锡能增加银汞合金凝固前的可塑性，但它也会增加凝固过程中的体积收缩，降低银汞合金的强度、硬度和抗腐蚀能力。因此在满足一定合金速度的条件下，应尽量降低合金粉中锡的用量甚至去除所含锡汞相（D对）。锌能改善银汞合金的脆性，增加可塑性，不应去除所含锌的成分（A错）。银汞合金粉颗粒较大，外形为不规则条状，堆积密度较小，颗粒间空隙较大，与汞形成的强度不高，因屑形此采用屑形银合金粉（B错）不能促进银汞合金的性能改进。低铜银合金粉中，银是形成银汞合金的主体成分，是银汞合金强度的主要贡献者，去除所含银汞相（C错）会降低银汞合金的强度。